调节泪腺分泌的副交感神经纤维源于
A. 动眼神经副核
B. 上泌涎核
C. 下泌涎核
D. 迷走神经背核
E. 疑核

正确答案：B。上泌涎核

解析：面神经的一般内脏运动纤维起自上泌涎核（B对），分别经翼腭神经节和下颌下神经节换神经元，节后纤维分布于泪腺、舌下腺、下颌下腺以及鼻腔、口腔黏膜的腺体。